患者发病时突然尖叫，跌仆于地，口吐涎沫，肢体抽搐。应首先考虑的是
A. 中风
B. 脱证
C. 痫证
D. 痿证
E. 脏躁

正确答案：C。痫证

解析：患者发病时突然尖叫，跌仆于地，为神机受累，元神失控的表现；口吐涎沫，肢体抽搐为痰浊内阻，脏气不平，阴阳偏盛，诊断为痫证（C对）。中风是以猝然昏仆，不省人事，半身不遂，口眼歪斜，语言不利为主症的病症（A错）。脱证临床可见神志不清，目合口开，四肢松懈瘫软，手撒肢冷汗多，二便自遗，鼻息低微等（B错）。萎证是指肢体筋脉弛缓，软弱无力，不能随意运动，或伴有肌肉萎缩的一种病症（D错）。脏躁多表现为精神忧郁，烦躁不安，无故哭泣，哭笑无常，喜怒无定，哈欠频作，不能自控者，多见于女性（E错）。